脑干内的非脑神经核
A. 三叉神经运动核
B. 动眼神经副核
C. 红核
D. 展神经核
E. 都不是

正确答案：C。红核

解析：红核（C对）由颅侧的小细胞部和尾侧的大细胞部组成；三叉神经运动核（A错）为 特殊内脏运动核；动眼神经副核（B错）节后纤维支配睫状肌和瞳孔括 约肌的收缩，以调节晶状体的曲度和缩小瞳孔；展神经核（D错），支配眼外直肌的随意运动。